两性离子表面活性剂
A. 卵磷脂
B. 吐温80
C. 司盘80
D. 卖泽
E. 十二烷基硫酸钠

正确答案：A。卵磷脂

解析：本题考查表面活性剂。卵磷脂（A对）属于两性离子表面活性剂；吐温80（B错）为非离子型表面活性剂；司盘80（C错）为非离子型表面活性剂；卖泽（D错）为非离子型表面活性剂；十二烷基硫酸钠（E错）为阴离子型表面活性剂。